以下哪种不是单克隆抗体的特点
A. 识别一种抗原表位
B. 制备成本高
C. 纯度高
D. 效价高
E. 特异性强

正确答案：B。制备成本高